疑似输血引起的不良后果的，医患双方应当共同对现场实物进行封存，封存的现场实物应由
A. 患者保管
B. 医疗机构保管
C. 患者和医疗机构共同委托的第三人保管
D. 患者和医疗机构任何一方均可以保管
E. 医疗机构所在地的卫生行政部门保管

正确答案：B。医疗机构保管

解析：疑似输液、输血、注射、药物等引起不良后果的，医患双方应当共同对现场实物进行封存和启封，封存的现场实物由医疗机构保管。掌握“医疗事故处理概述、预防与处置”知识点。